善治脾肺气阴两伤的药物是
A. 黄芪
B. 白术
C. 甘草
D. 山药
E. 南沙参

正确答案：D。山药

解析：本题考查的是山药的性能特点。善治脾肺气阴两伤的药物是山药（D对）。山药：【性能特点】本品甘补兼涩，性平不偏，归脾、肺、肾经，虽药力平和，但兼涩敛之性。既平补气阴，为治气虚或气阴两虚之佳品。又滋阴益气而生津，为治肾阴虚及消渴所常用。还固精止带，为治肾虚不固之要药。黄芪（A错）：【性能特点】本品甘温补升，甘淡渗利；生用微温，蜜炙性温，入脾、肺经，主以扶正气，兼能除水邪。既善补中气、升举清阳，又善补肺气、益卫固表，治脾肺气虚、中气下陷、气不摄血、自汗盗汗等，还能托疮毒、利水消肿，治气血不足之疮痈不溃或久溃不敛，以及气虚水肿、小便不利。此外，通过补气又能生血、摄血、生津、行滞，治血虚萎黄、气不摄血之崩漏便血、气津两伤之消渴、气虚血滞之痹痛麻木和半身不遂等。白术（B错）：【性能特点】本品甘补渗利，苦温而燥，入脾、胃经，主以温补扶正，兼能祛除水湿。善补气健脾、燥湿利水、止汗、安胎，治脾胃气虚、脾虚水肿、痰饮、表虚自汗及胎动不安。生用、炒用性能小有差别，炒后补脾力强，生用祛湿力强。补气、固表、利水与黄芪相似，力虽稍缓，但长于燥湿与安胎。甘草（C错）：【性能特点】本品甘补润缓，生平偏凉，炙平偏温，主入脾、肺经，兼入胃、心经。既益气补中，又缓急止痛、缓和药性，还祛痰止咳、解毒。蜜炙补气缓急力强；生用能泻火解毒。南沙参（E错）：【性能特点】本品味甘能补，微苦微寒清泄，入肺、胃经，为凉补之品。主清肺养阴、益胃生津，兼益气、祛痰，善治肺胃阴虚有热诸证，兼气虚或夹痰者尤宜。